为促进药物释放，在氨茶碱可可豆脂栓剂中，宜加入少量非离子型表面活性剂，其HLB值应在
A. 11以上
B. 10～7之间
C. 6～3之间
D. 2～0之间
E. 0以下

正确答案：A。11以上